不能消除可摘局部义齿翘动的是
A. 增加间接固位体
B. 增大平衡距
C. 增大游离距
D. 增加基托面积
E. 骨突处基托组织面缓冲

正确答案：C。增大游离距

解析：本题考查义齿不稳定的消减方法。不能消除可摘局部义齿翘动的是增大游离距（C错，为本题正确答案）。增大游离距使游离端下沉程度加重，义齿前部翘起。义齿不稳定的消减方法从力矩平衡和消除支点两个方面着手，可设置平衡力、增强支持力、减少不稳定作用力、消除或减弱支点作用。增加间接固位体（A对）用以防止义齿翘动。增大平衡距（B对）以增大平衡力，用于防止左右翘动的。增加基托面积（D对）可以增强义齿稳定性。骨突是义齿翘动的一个原因，骨突处基托组织面缓冲（E对）可以消除翘动。